阿司匹林的抗血小板作用机制为
A. 抑制血小板中TXA₂的合成
B. 抑制内皮细胞中TXA₂的合成
C. 激活环氧酶
D. 促进内皮细胞中PGI₂的合成
E. 促进血小板中PGI₂的合成

正确答案：A。抑制血小板中TXA₂的合成

解析：本题考查阿司匹林抗血小板的作用机制。阿司匹林的抗血小板作用机制为抑制血小板中TXA₂的合成（A对）。阿司匹林是环氧酶抑制剂，通过与COX-1活性部位的羟基发生不可逆的乙酰化，导致COX-1失活，继而阻断了花生四烯酸转化为TXA₂，抑制血小板中TXA₂的合成。